便秘的基本病变是
A. 大肠传导功能失司
B. 邪蕴肠腑，气血壅滞
C. 湿困脾土，肠道功能失司
D. 湿热内郁不清
E. 阴虚有热，传导失司

正确答案：A。大肠传导功能失司

解析：便秘的病位在大肠，基本病机为邪滞大肠，腑气闭塞不通或肠失温煦濡养，引起肠道传导失司（A对）。邪蕴肠腑，气血壅滞（B错）是痢疾的病机。湿困脾土，肠道功能失司（C错）是泄泻的病机。湿热内郁不清（D错）易导致湿热痢疾。阴虚有热，传导失司（E错），是导致便秘的常见病机之一，但不是便秘的基本病机。